无血缘关系的同种器官移植时，发生排斥反应的主要原因是
A. 移植物供血不足
B. 受者体内有抗供者组织抗原的抗体
C. MHC不相配
D. 受者免疫功能紊乱
E. 受者体内有自身反应性T细胞

正确答案：C。MHC不相配